影响大气污染物浓度的气象因素包括
A. 气流、气压、光照
B. 气温、空气离子、气压、雷电
C. 气温、气流、气压、气湿
D. 气温、气流、气湿、雷电
E. 气温、气流、光照、空气离子

正确答案：C。气温、气流、气压、气湿

解析：本题考查影响大气污染物浓度的气象因素。影响大气污染的气象因素包括：1.风和湍流：它们对污染物在大气中的稀释和扩散起着决定性作用；2.温度层结：即气温的垂直梯度，它决定大气的稳定程度，影响大气湍流的强弱；3.气压：气压的高低与海拔高度、地理纬度和空气温度等有关；4.气湿：即大气中含水的程度，通常用相对湿度（%）表示（C对ABDE错）。